慢性牙周炎中度附着丧失一般为
A. 1～2mm
B. ＞2mm
C. 2mm
D. 3～4mm
E. 5mm以上

正确答案：D。3～4mm

解析：慢性牙周炎中度：牙周袋≤6mm，附着丧失3～4mm，X线片显示牙槽骨水平型或角型吸收超过根长的1/3，但不超过根长的1/2。牙齿可能有轻度松动，多根牙的根分叉区可能有轻度病变，牙龈有炎症和探诊出血，也可有脓。掌握“慢性牙周炎的病因，表现诊断及预后”知识点。